用酸度计测定溶液的pH值时，应先对仪器进行校正，校正时应使用
A. 任何一种标准缓冲液
B. 任何两种标准缓冲液
C. 与供试液的pH值相同的标准缓冲液
D. 两种pH值相差约3个单位的标准缓冲液，并使供试液的pH值处于二者之间
E. 两种pH值相差约5个单位的标准缓冲液，并使供试液的pH值处于二者之间

正确答案：D。两种pH值相差约3个单位的标准缓冲液，并使供试液的pH值处于二者之间